多数药物作用于受体发挥药效，受体的主要类型有
A. G蛋白偶联受体
B. 配体门控离子通道受体
C. 酶活性受体
D. 电压依赖性钙离子通道
E. 胞核激素受体

正确答案：A、B、C、E。G蛋白偶联受体；配体门控离子通道受体；酶活性受体；胞核激素受体

解析：本题考查受体。受体的类型包括：G-蛋白偶联受体（A对）、配体门控离子通道受体（B对）、酪氨酸激酶受体（C对）、细胞内受体（如细胞核激素受体）（E对）。离子通道按生理功能分类，可分为配体门控离子通道及电压门控离子通道。电压依赖性钙离子通道（D错）属于配体门控离子通道受体。